涎腺多形性腺瘤与其他唾液腺肿瘤鉴别的病理要点是
A. 具有黏液样成份
B. 具有软骨样成份
C. 具有癌的成份
D. 具有肉瘤成份
E. 具有涎腺多形性腺瘤成份

正确答案：E。具有涎腺多形性腺瘤成份

解析：本题考查多形性腺瘤。涎腺多形性腺瘤与其他唾液腺肿瘤鉴别的病理要点是具有涎腺多形性腺瘤成份（E对）。多形性腺瘤的组织像具有多形性特征，即肿瘤性上皮细胞与黏液，软骨样组织混杂在一起故称“多形性”，而其他唾液腺肿瘤所含的组织像成分虽然不同但比较单一，多见于排列方式的不同，不具有“多形性”的特征。